使用1：213的碘伏作为表面消毒剂时推荐接触时间是
A. 45～50分钟
B. 35～40分钟
C. 25～30分钟
D. 15～20分钟
E. 5～10分钟

正确答案：E。5～10分钟

解析：本题考查碘伏消毒。使用1：213的碘伏作为表面消毒剂时推荐接触时间是5～10分钟（E对）。使用1：213的稀释溶液碘伏，用作表面消毒剂或浸泡，保持10min。